VDT作业的主要职业性危害为
A. 身心紧张
B. 精神疲劳、视力下降
C. 视觉、骨骼肌、心理紧张
D. 心理、躯体紧张
E. 视觉疲劳、坐姿静力作业

正确答案：C。视觉、骨骼肌、心理紧张